男，2岁。P100～110次/分，胸骨左缘3～4肋间3/6级收缩期杂音，肺动脉第2音亢进。胸片示左右心室扩大。应诊断为
A. 房间隔缺损
B. 室间隔缺损
C. 动脉导管未闭
D. 肺动脉狭窄
E. 法洛氏四联症

正确答案：B。室间隔缺损

解析：患儿肺动脉第二心音亢进提示肺动脉压力较高，提示肺循环血量较多；胸骨左缘3～4肋间3/6级收缩期杂音提示病变位于室间隔；胸片所示左右心室扩大为室间隔缺损的典型影像学表现（B对）。房间隔缺损（A错）X线表现以右心房右心室增大为主，可见“肺门舞蹈”征。动脉导管未闭（C错）X线表现为左心房左心室增大。肺动脉狭窄（D错）X线特征表现为狭窄后肺动脉扩张。法洛氏四联症（E错）主要表现为青紫，X线典型表现前后位心影呈“靴状。